女，36岁，患风心病10年，近来心悸、胸闷痛、气短，下肢浮肿，尿少。数分钟前突然晕倒，意识丧失，皮肤苍白，唇绀，大动脉搏动扪不到，呼吸停止，其原因是
A. 脑栓塞
B. 急性左心衰竭
C. 癫痫大发作
D. 心脏性猝死
E. 急性右心衰竭

正确答案：D。心脏性猝死

解析：患者中年女性，有10年风心病史，近来心悸、胸闷痛、气短，下肢浮肿，尿少，提示心衰（风心病患者二尖瓣最常受累，其次是主动脉瓣）。患者突然晕倒，意识丧失，唇绀，大动脉搏动扪不到，呼吸停止，为心脏性猝死的表现（D对）。脑栓塞（A错）主要发生于中老年，多由动脉粥样硬化的病因，风心病疣状赘生物不易脱落。急性左心衰竭（B错）（P174）时有急性肺淤血、肺水肿并可伴组织器官灌注不足和心源性休克的临床综合征。急性右心衰竭（E错）（P174）是引起右心排血量急剧减低的临床综合征，有外周静脉淤血征象，如颈静脉怒张，肝大压痛，肝-颈静脉反流阳性。癫痫大发作（C错）也称全身性强直—阵挛发作，以意识丧失和全身抽搐为特征。